下列哪个药物能诱发支气管哮喘
A. 酚妥拉明
B. 普萘洛尔
C. 酚苄明
D. 洛贝林
E. 阿托品

正确答案：B。普萘洛尔